现况调查对象的选择原则是
A. 从人群中选择有某病与无某病者
B. 从人群中选择暴露与非暴露某因素者
C. 从医院和人群中随机抽样选择患某病的人
D. 从人群中随机抽样选择部分人群
E. 从人群中随机抽样选择部分健康人群

正确答案：D。从人群中随机抽样选择部分人群